以下哪一点是属于最优化原则的内容
A. 时间最早
B. 痛苦最少
C. 没有副作用
D. 知情同意
E. 保守秘密

正确答案：B。痛苦最少

解析：最优化原则的内容包括：痛苦最小、费用最少、副作用最小、效果最好、安全度最高。